急性皮肤刺激试验适用于
A. 每日使用的化妆品
B. 所有护肤类化妆品
C. 含刺激性物质的化妆品
D. 含限用物质的化妆品
E. 间隔数日使用的化妆品

正确答案：E。间隔数日使用的化妆品

解析：本题考查急性皮肤刺激试验的适用情况。急性皮肤刺激试验适用于间隔数日使用（E对BCD错）和用后冲洗的化妆品。每天使用的化妆品（A错）需进行多次皮肤刺激性试验，进行多次皮肤刺激试验的不再进行急性皮肤刺激性试验。